对肝微粒体酶活性具有抑制作用的药物是
A. 苯妥英钠
B. 异烟肼
C. 尼可刹米
D. 卡马西平
E. 水合氯醛

正确答案：B。异烟肼

解析：本题考查药物代谢酶抑制剂。对肝微粒体酶活性具有抑制作用的药物是异烟肼（B对）。常见的肝药酶抑制剂有：氯霉素、异烟肼、胺碘酮、红霉素、甲硝唑、咪康唑等；常见的肝药酶诱导剂有：苯妥英钠（A错）、尼可刹米（C错）、卡马西平（D错）、水合氯醛（E错）、利福平、螺内酯等。